获得性免疫缺陷综合征患者主要受损的靶细胞是
A. CD8⁺T细胞
B. B1细胞
C. CD4⁺T细胞
D. NK细胞
E. B2细胞

正确答案：C。CD4⁺T细胞

解析：HIV主要侵犯人体免疫系统，包括CD4+T淋巴细胞（C对）、巨噬细胞和树突状细胞，主要表现为由CD4+T淋巴细胞数量不断减少而导致免疫功能缺陷。